门静脉高压症手术、术后最易发生肝性脑病的术式是
A. 非选择性门体分流术
B. 食管下端胃底切除术
C. 限制性门体分流术
D. 远端脾-肾静脉分流术
E. 贲门周围血管离断术

正确答案：A。非选择性门体分流术

解析：门静脉收集腹腔不成对器官的血液，入肝血液经过肝脏代谢后，可降低血液中氨等有毒物质及废物的含量，使进入体循环的血液毒性大大减低，降低对其他重要脏器的损伤。非选择性门体分流术（A对）可降低门静脉高压引起的消化道大出血的风险，但由于门静脉收集的血液未经肝脏解毒处理，氨等毒性物质可直接进入体循环，进而进入脑组织，透过血脑屏障，引发肝性脑病，此术式是最易发生肝性脑病的术式。食管下端胃底切除术（B错）和贲门周围血管离断术（E错）仅降低了门脉高压患者消化道大出血的风险，并未改变入肝血流量，肝脏可对入肝血液进行解毒处理，进入体循环的毒素量少，诱发肝性脑病的几率低；限制性门体分流术（C错）和远端脾-肾静脉分流术（D错）仅将部分入肝的血液直接引入体循环，进入体循环的毒素含量相对较少，引发肝性脑病的几率相对非选择性门体分流术较低，以上术式均不是最易发生肝性脑病的术式。